下列不属于材料制作程序的是
A. 分析需求和确定信息
B. 制订计划
C. 形成初稿
D. 预试验
E. 建立专家审查小组

正确答案：E。建立专家审查小组